将数据0.53624、0.0014、0.25、1.6、10.0相加，正确的结果是
A. 12.4
B. 12.39
C. 12.388
D. 12.3876
E. 12.38764

正确答案：A。12.4

解析：本题考查有效数字运算规则。加减法：先按小数点后位数最少的数据保留其他各数的位数，再进行加减计算，计算结果也保留相同的位数。0.53624+0.0014+0.25+1.6+10.0=0.5+0.0+0.3+1.6+10.0=12.4（A对）。